能引起肾病综合征的疾病是
A. 隐匿性肾炎
B. 间质性肾炎
C. 急性肾盂肾炎
D. 慢性肾盂肾炎
E. 狼疮性肾炎

正确答案：E。狼疮性肾炎

解析：好发于青少年和中年妇女，可引起肾病综合征。掌握“慢性肾小球肾炎、肾病综合征”知识点。